女性，78岁。晨起进行性左侧肢体无力，有糖尿病史。体检：左鼻唇沟浅，伸舌偏左，左上下肢肌力2级，腱反射右﹥左，跖反射左无反应，左偏侧针刺觉降低，血压130/70mmHg，CT无异常。临床诊断为
A. 右侧半球脑栓塞
B. 右侧半球脑出血
C. 右侧半球脑血栓形成
D. 蛛网膜下腔出血
E. 以上都不是

正确答案：C。右侧半球脑血栓形成